某男性患者，37岁，体检查出空腹血糖9.79mmol/L，尿糖（++），本人无明显不适。入院复查餐后血糖、糖化血红蛋白，医师诊断为2型糖尿病，并给予磺酰脲类降糖药。患者考虑到使用上述药物的副作用，想改用胰岛素，那么不宜用胰岛素的病症是
A. 糖尿病合并严重感染
B. 胰岛功能尚可的糖尿病
C. 重症糖尿病
D. 酮症酸中毒
E. 胰岛功能基本丧失的糖尿病

正确答案：B。胰岛功能尚可的糖尿病

解析：本题考查胰岛素的适应证。某男性患者，37岁，体检查出空腹血糖9.79mmol/L，尿糖（++），本人无明显不适。入院复查餐后血糖、糖化血红蛋白，医师诊断为2型糖尿病，并给予磺酰脲类降糖药。患者考虑到使用上述药物的副作用，想改用胰岛素，那么不宜用胰岛素的病症是胰岛功能尚可的糖尿病（B错，为本题的正确答案）。糖尿病合并严重感染（属于糖尿病的慢性并发症）（A对）、重症糖尿病（C对）、酮症酸中毒（属于糖尿病的急性并发症）（D对）、胰岛功能基本丧失的糖尿病（E对）均属于胰岛素的适应症。